基因表达调控主要是指
A. DNA复制上的调控
B. 转录后的修饰
C. 蛋白质折叠的形成
D. 转录的调控
E. 逆转录的调控

正确答案：D。转录的调控

解析：基因表达调控主要是指转录的调控（D对），因为遗传信息经转录由DNA传向RNA过程中的许多环节，是基因表达调控最重要、最复杂的一个层次。DNA复制上的调控（A错）、转录后的修饰（B错）、蛋白质折叠的形成（C错）、逆转录的调控（E错）均属于基因的表达调控，但都不是最主要的。